儿科医师开具的脱石散剂处方，在售药店调剂后的保存期限为
A. 1年
B. 2年
C. 3年
D. 5年

正确答案：B。2年

解析：本题考查药店零售。儿科医师开具的脱石散剂处方，在售药店调剂后的保存期限为2年（B对）。《处方药与非处方药流通管理暂行规定》第三章药店零售第十条处方药必须凭执业医师或执业助理医师处方销售、购买和使用。执业药师或药师必须对医师处方进行审核、签字后依据处方正确调配、销售药品。对处方不得擅自更改或代用。对有配伍禁忌或超剂量的处方，应当拒绝调配、销售，必要时，经处方医师更正或重新签字，方可调配、销售。零售药店对处方必须留存2年以上备查。处方由调剂处方药品的医疗机构妥善保存。普通处方、急诊处方、儿科处方保存期限为1年（A错），医疗用毒性药品处方保存期限为2年。罂粟壳，必须凭盖有乡镇卫生院以上医疗机构公章的医生处方配方使用，不准生用，严禁单味零售，处方保存3年（C错）备查。